不属于传统的保藏方法是
A. 辐照保藏
B. 脱水保藏
C. 发酵保藏
D. 盐渍
E. 糖渍

正确答案：A。辐照保藏